重楼原植物所属的科是
A. 百合科
B. 姜科
C. 百部科
D. 兰科
E. 茜草科

正确答案：A。百合科

解析：本题考查的是重楼的来源。重楼原植物所属的科是百合科（A对）。重楼：【来源】为百合科植物云南重楼或七叶一枝花的干燥根茎。来源于姜科（B错）的中药有莪术、姜黄、郁金、砂仁、草果、豆蔻、草豆蔻、益智等。来源于百部科（C错）的中药有百部等。来源于兰科（D错）的中药有天麻、白及、石斛、铁皮石斛等。来源于茜草科（E错）的中药有巴戟天、茜草、钩藤、栀子、白花蛇舌草等。